脂质体突释效应不应过大，0.5小时释放量应低于
A. 0.05
B. 0.1
C. 0.2
D. 0.3
E. 0.4

正确答案：E。0.4

解析：本题考查突释效应。突释效应是指在体外释放试验中，液体介质中未包封的药物或脂质体表面吸附的药物会快速释放。突释效应开始0.5小时内释放量应低于40％（E对）。